下列情况中，血浆D-二聚体测定结果正常的是
A. 原发性纤溶亢进症
B. 急性肺梗死
C. 下肢深静脉血栓形成
D. 急性心肌梗死
E. 弥散性血管内凝血

正确答案：A。原发性纤溶亢进症

解析：血浆D-二聚体在继发性纤溶症（如弥散性血管内凝血（DIC））（E错）增高，而原发性纤溶症（A对）的早期正常。下肢深静脉血栓形成（C错）时纤溶系统被激活，血液中D-二聚体浓度上升。急性肺梗死（B错）、急性心肌梗死（D错）时机体高凝状态，可出现D-二聚体增高；此外急性白血病、恶性肿瘤、冠心病、手术后、重症肝炎、肝硬化和慢性活动性肝炎时，D-二聚体亦可增高。